下列各项，提示胎儿储备能力异常的项目是
A. OCT阴性
B. FHR有加速和减速的变化
C. 胎动30次/12小时
D. NST是宫缩时FHR的变化
E. NST出现反应型

正确答案：D。NST是宫缩时FHR的变化

解析：NST是宫缩时FHR（胎心率）的变化，可以提示胎儿的储备能力（D对）。缩宫素激惹试验（OCT）∶又称宫缩应激试验（CST），其原理是诱发宫缩并用胎儿监护仪记录胎心的变化，本方法是了解胎盘于宫缩时一过性缺氧的负荷试验，以测定胎儿的储备能力，OCT阴性表明暂时胎儿在宫内无缺氧（A错）。一般12小时胎动不少于30次就是正常的（C错）。胎心加速通常与胎动有关，表示胎儿状态良好（B错），胎心减速又分为早期减速和晚期减速，变异减速三种类型，第一，早期减速是与工作同步的对称性的减速，是由于胎头受压引起迷路神经反射所导致的，引起暂时胎儿缺氧，为良性过程，第二，晚期减速是在宫缩高峰或稍后出现的对症性的减速，与胎盘血流灌注不足和胎盘功能不全有关，第三个就是，变异减速指的是胎心减速，幅度大，恢复快，严重时，胎儿心率可降至六十次每分以下，多与胎儿脐带受压有关系的。正常胎儿NST出现反应型（E错）。